体外试验有
A. 小鼠微核试验
B. 大鼠精子畸变试验
C. 骨髓细胞染色体畸变试验
D. 人体外周血淋巴细胞染色体试验
E. 显性致死试验

正确答案：D。人体外周血淋巴细胞染色体试验